急性肾小球肾炎血清补体C3一过性明显下降，恢复正常的时间是
A. 2～3周
B. 4～5周
C. 6～8周
D. 9～11周
E. 12～15周

正确答案：C。6～8周

解析：急性肾小球肾炎起病初期，血清补体C3一过性明显下降，6~8周内逐渐恢复正常，为急性肾小球肾炎的典型表现（C对）。